望神的重要内容是
A. 视面部表情
B. 望形态动静
C. 看眼神的变化
D. 观言语气息
E. 察精神意识状态

正确答案：C。看眼神的变化

解析：本题考查的是望神的概念。望神的重要内容是看眼神的变化（C对）。望神，就是观察患者的精神好坏、意识是否清楚、动作是否矫健协调、反应是否灵敏等方面的情况，以判断脏腑阴阳气血的盛衰和疾病的轻重预后。由于“目”为五脏六腑精气之所注，其目系通于脑，为肝之窍，心之使，“神藏于心，外候在目”，所以察眼神的变化又是望神的重要内容之一。形是形体，态是姿态。望形态（B错）是通过望病人形体的强弱胖瘦及异常的动静姿态，以测知病情的一种诊法。听声音，主要是听病人言语气息（D错）的高低、强弱、清浊、缓急等各种异常变化，包括语声、语言、呼吸、咳嗽、呃逆、呕吐、嗳气等声响的异常，以判断病变寒热虚实的性质。神情是指人的精神意识（E错）和面部表情（A错），它是心神和脏腑精气盛衰的外在表现。